乳牙广泛浅龋治疗所用药物不包括
A. 2％氟化钠
B. 8％氟化亚锡
C. 硝酸银
D. 38％氟化氨银
E. 30％过氧化氢溶液

正确答案：E。30％过氧化氢溶液

解析：本题考查龋病的药物治疗。30％过氧化氢溶液（E错，为本题的正确答案）具有强氧化性，可使色素溶解，常用于有色牙如四环素牙、氟斑牙的脱色治疗。药物治疗也称为非手术治疗。药物治疗的药物主要是氟化物。以涂药方法治疗龋病，主要适用于龋损面广泛的浅龋或剥脱状的环状龋，不易制备洞形的乳牙。乳牙广泛浅龋治疗所用药物主要有2％氟化钠溶液（A对），1.23%酸性氟磷酸钠溶液，8％氟化亚锡（B对），75%氟化钠甘油糊剂，10%氨硝酸银溶液（C对），38％氟化氨银溶液（D对），氟保护漆等。